男性，44岁，工人，自诉20年前因不慎感冒而咳嗽、咳痰，1周后发生气短而喘，以后每逢气候改变或精神激动时即发生气喘及咳嗽，闻油烟也有阵发，20年来经抗生素治疗无效，目前检查桶状胸，两肺有散在高调干啰音，心脏无显著改变，请问原发病是什么
A. 急性支气管炎
B. 慢性支气管炎
C. 过敏性肺炎
D. 支气管哮喘
E. 喘息性支气管炎

正确答案：D。支气管哮喘

解析：男性，44岁，工人，自诉20年前因不慎感冒而咳嗽、咳痰，1周后发生气短而喘，以后每逢气候改变或精神激动时即发生气喘及咳嗽，闻油烟也有阵发（刺激性咳嗽），20年来经抗生素治疗无效（提示非感染），目前检查桶状胸（提示肺气肿），两肺有散在高调干啰音，综上考虑诊断为支气管哮喘（D对）。急性支气管炎（A错）是病毒或细菌等病原体感染所致的支气管黏膜炎症。出现前常有急性上呼吸道感染的症状，寒战高热肌肉痛等，且抗生素治疗常有效。慢性支气管炎（B错）多见于中老年人，缓慢起病，病程长，表现为反复的咳嗽、咳痰或伴有喘息，该患者没有明显的咳痰症状。过敏性肺炎（C错）是易感人群反复吸入各种具有抗原性的有机粉尘、低分子量化学物质引起的一组弥漫性间质性肉芽肿性肺病，表现为发热、干咳、呼吸急促、胸痛及缺氧、口唇、指趾末端发绀等，发作时肺部体征与哮喘发作时不同，多无哮鸣音，主要听到的是湿性啰音。喘息性支气管炎（E错）是指气管、支气管粘膜及其周围组织的慢性非特异性炎症，临床上以长期咳痰或伴有喘息及反复发作为特征，急性发作期查体可闻及干、湿啰音。